关于三角肌的描述，错误的是
A. 位于肩部，呈三角形
B. 使肩关节外展
C. 止于三角肌粗隆
D. 只起于肩胛骨
E. 受腋神经支配

正确答案：D。只起于肩胛骨

解析：三角肌位于肩部，呈三角形（A对），起于锁骨外侧1/3，肩峰和肩胛冈，而非只起于肩胛骨（D错，为本题正确答案），止于三角肌粗隆（C对），使肩关节外展（B对），受腋神经支配（E对）。